第I躯体运动区中与下肢的运动有关的部位是
A. 中央前回的上部和中央旁小叶前部
B. 中央前回的上部和中央旁小叶后部
C. 中央前回的中部和中央旁小叶后部
D. 中央前回的中部和中央旁小叶后部
E. 中央前回的下部和中央旁小叶前部

正确答案：A。中央前回的上部和中央旁小叶前部

解析：第Ⅰ躯体运动区位于中央前回和中央旁小叶前部，该中枢对骨骼肌运动的管理特点之一为上下颠倒，即与下肢的运动有关的部位投射在中枢是位于中央前回的上部和中央旁小叶前部（A对）；若与躯干、上肢的运动有关的部位则投射在中央前回的中部；若与面、舌、咽、喉的运动有关的部位则投射在中央前回的下部。